钙的主要食物来源是
A. 动物肝脏
B. 奶及奶制品
C. 蔬菜、水果
D. 豆类
E. 粮谷类

正确答案：B。奶及奶制品

解析：奶及奶制品是钙的良好来源，含量丰富，吸收率高；水产品中小虾皮含钙高，其次是海带。掌握“合理营养指导”知识点。